非水碱量法所用的溶剂是
A. 硝酸
B. 高氯酸
C. 盐酸
D. 冰醋酸
E. 氨水

正确答案：D。冰醋酸

解析：本题考查非水溶液滴定法。非水碱量法是以冰醋酸（D对）或冰醋酸-醋酐为溶剂，高氯酸（B错）为滴定液。酸碱滴定法常用的酸标准溶液是盐酸（C错），有时也用硝酸（A错）。氨水（E错）可在络合滴定中充当辅助剂。